关于药物的吸收说法，不正确的是
A. 药物分子的解离有利于跨膜吸收
B. 弱酸性药物在碱性环境中有利于吸收
C. 胃排空速率是影响药物吸收的重要因素
D. 高脂肪饮食可增加脂溶性药物的吸收
E. 难溶性药物可采用微粉化技术提高溶出速度，加快药物吸收

正确答案：A、B。药物分子的解离有利于跨膜吸收；弱酸性药物在碱性环境中有利于吸收

解析：本题考查药物的吸收。细胞膜为脂溶性双分子膜，药物以分子形式通过，解离不利于跨膜吸收（A错，为本题正确答案）。通常酸性药物在pH低的胃中、碱性药物在pH高的小肠中的未解离型药物量增加，吸收也增加，反之都减少（B错，为本题正确答案）。